我国生活饮用水中规定的氟化物的限量标准为
A. 1.5mg/L
B. 1.0mg/L
C. 2.0mg/L
D. 3.0mg/L
E. 4.0mg/L

正确答案：B。1.0mg/L

解析：本题考查我国生活饮用水中规定的氟化物的限量标准。综合考虑氟在lmg/L时对牙齿的轻度影响和防龋作用，以及高氟地区除氟在经济技术上的可行性，我国生活饮用水中规定的氟化物的限量标准不应超过1.0mg/L（B对ACDE错）。